疼痛轻微，皮色不变，压之酸痛，其痛的辩证为
A. 寒痛
B. 气痛
C. 湿痛
D. 痰痛
E. 风痛

正确答案：D。痰痛

解析：寒痛 皮色不红，不热，酸痛，得温则痛缓（A错）。气痛 攻痛无常，时感抽掣，喜缓怒甚（B错）。湿痛：痛而酸胀，肢体沉重，按之出现可凹性水肿或见糜烂流滋。（C错）。痰痛 疼痛轻微，或隐隐作痛，皮色不变，压之酸痛（D对）。风痛 痛无定处，忽彼忽此，走注甚速，遇风则剧（E错）。